秦皮伪品核桃楸皮的水浸液在日光下
A. 显碧蓝色荧光
B. 显棕红色荧光
C. 无荧光
D. 显浅黄棕色荧光
E. 显亮绿色荧光

正确答案：C。无荧光